产后出血是指胎儿娩出后阴道出血量超过多少毫升
A. 300mL
B. 400mL
C. 500mL
D. 600mL
E. 700mL

正确答案：C。500mL

解析：产后出血指胎儿娩出后24小时内出血量超过500mL，剖宫产时超过1000mL，是分娩期的严重并发症（C对）。